外伤致头颅骨折，塌陷2cm，昏迷半小时，醒来4小时，意识清楚，对答如流说头晕，恶心，呕吐，然后又昏迷。此时应选的首要措施为
A. 手术
B. 甘露醇
C. 抗感染
D. 机械通气
E. 卧床观察

正确答案：A。手术

解析：患者外伤头颅骨折，表现为昏迷-中间清醒-再昏迷（硬膜外血肿的特征性症状）且中间清醒期伴有头晕、恶心、呕吐（提示颅内压增高），根据该患者的临床症状及体征，考虑诊断为颅骨骨折伴硬膜外血肿，且该患者存在颅内压增高的症状，所以应选的首要措施为手术（A对）。